能够赋予新生儿抗感染免疫力的是
A. 穿越胎盘
B. 调理吞噬
C. 穿越黏膜
D. 介导细胞杀伤
E. 介导Ⅰ型超敏反应

正确答案：A。穿越胎盘

解析：穿越胎盘：IgG可通过胎盘滋养层细胞表达的新生Fc段受体（FcRn）转移进入胎儿血液循环，赋予新生儿抗感染免疫力。掌握“免疫球蛋白的类型及功能”知识点。